女性农民，发热4天，昨天尿量680ml，呈酒醉貌，注射部位可见片状瘀斑，尿蛋白（++++），下列处理不正确的是
A. 立即查血常规
B. 立即查流行性出血热抗体
C. 立即补充血容量
D. 立即应用呋塞米200mg静脉注射
E. 立即查电解质及CO2CP

正确答案：D。立即应用呋塞米200mg静脉注射